下列哪种属于自然被动免疫
A. 注射丙种球蛋白
B. 注射抗毒素血清
C. 经胎盘从母体得到的抗体
D. 接种类毒素产生的抗体
E. 接种疫苗产生的抗体

正确答案：C。经胎盘从母体得到的抗体